中、晚期肝癌最常见的主要体征是
A. 肝区疼痛
B. 肝大
C. 黄疸
D. 全身和消化道症状
E. 转移灶表现

正确答案：B。肝大